盗汗的特点是
A. 大汗淋漓
B. 经常出汗，动则更甚
C. 手足心出汗
D. 入睡出汗，醒后汗止
E. 半侧身体出汗

正确答案：D。入睡出汗，醒后汗止

解析：本题考查的是盗汗的临床表现及意义。盗汗的特点是入睡出汗，醒后汗止（D对）。问汗出的临床意义：汗为心液，是阳气蒸化津液，出于体表而成，即所谓“阳加于阴谓之汗”。出汗的病变，在外感证和内伤证中都可以见到。询问出汗的情况，首先要问有汗或无汗，然后再进一步问清出汗的时间、出汗的部位，汗量的多少及其主要兼证等。兹将常见汗出辨析分述如下。1.表证辨汗的临床意义：表证是病位在肌表，了解表证有汗与无汗，往往可以分辨感受外邪的性质和正气的盛衰。表证无汗，多属外感寒邪，如伤寒表实证之类，寒主收敛，使腠理致密、汗孔闭塞所致。表证有汗，多属外感风邪，如太阳中风证之类。因风性开泄，热性升散，均可使腠理疏松而汗出。因此，外感风热，以及卫阳虚弱、复感风热外邪的表证，都可以见到出汗。2.自汗临床表现及意义：自汗，指经常汗出不止，活动后加重（B错）的临床表现。多因气虚卫阳不固所导致，故常伴有神疲、乏力、气短、畏寒等阳气虚损的症状。3.盗汗临床表现及意义：盗汗，指入睡则汗出，醒后则汗止的临床表现。多因阴虚所导致，阴虚则阳亢，阳热亢盛，蒸发阴津而为汗，故常伴有五心烦热、失眠、颧红、口咽干燥等症。4.绝汗临床表现及意义：绝汗，指病情危重之时，大汗不止的临床表现。常见于亡阴、亡阳之危重病证，若大汗淋漓（A错），伴有呼吸喘促、神疲气弱、四肢厥冷、脉微欲绝等症，则为亡阳之汗，是元气欲脱、津随气泄的危候。若病势危重，汗出而黏如油、躁扰烦渴、脉细数疾者，则为亡阴之汗，是内热涸竭之阴津外泄之危候。5.战汗临床表现及意义：战汗，指先见全身恶寒战栗，而继之汗出的临床表现。战汗的发生是邪正相争、病变发展的转折点。如汗出热退、脉静身凉，是邪去正安的好转现象；若汗出而烦躁不安、脉来疾急，为邪胜正衰的危候。此外，还有上焦邪热，或中焦湿热郁蒸所致，汗出仅限于头部的头汗。老年人气喘而头额汗出，则多为虚证。如重病末期，突然额汗大出，是属虚阳上越、阴虚不能附阳、阴津随气而脱的危象。还有风痰或风湿之邪阻滞经脉，或营卫不周，或气血不和所致的半侧身体出汗（E错），或见于左侧，或见于右侧，或见于上半身，或见于下半身。还有阴经郁热熏蒸所致的手足心汗出（C错）；因思虑过度、劳伤心脾所致的独见于心胸部多汗等。